患者，男，58岁。胸痛患者，诊断为右侧胸膜炎而住院治疗，药物治疗1天胸痛消失，气促加重。该患者最大可能为
A. 炎症缓解
B. 胸水增多
C. 胸水减少
D. 入院后焦虑心情减轻
E. 采用了患侧卧位

正确答案：B。胸水增多

解析：胸膜炎疼痛是由于胸膜随呼吸运动的牵拉、相互摩擦所致，当胸腔积液量增加（B对），摩擦力减小，因此疼痛会减轻，但由于积液量的增加影响肺的扩张，引起胸闷、气促等。炎症缓解（A错）病情好转，因此在疼痛减轻的同时不会出现气促加重的症状。胸水减少（C错）不会引起肺组织压迫，故不会出现气促表现。由于患者原本以胸痛为主诉就诊，经药物治疗后疼痛消失，但气促加重，与心情（D错）、体位（E错）无明显关系。